从髁突中心至下颌中切牙近中切角连线与（牙合）平面所构成的交角称为
A. Bonwill角
B. Balkwill角
C. 鼻颏角
D. 鼻唇角
E. 鼻额角

正确答案：B。Balkwill角

解析：Balkwill角：从髁突中心至下颌中切牙近中切角连线与（牙合）平面所构成的交角称Balkwill角，正常平均26°。掌握“（牙合）分类及临床意义与面部结构”知识点。